下列哪项是流行病学实验研究的优点
A. 可计算相对危险度和归因危险度
B. 能够及早治疗患者或预防和控制疾病
C. 可平衡和控制两组的混杂因素，提高可比性
D. 易于控制失访偏倚
E. 省时、省钱、省力

正确答案：C。可平衡和控制两组的混杂因素，提高可比性